有关母乳最适合婴儿生长发育需要的描述，正确的是
A. 母乳所含酪蛋白多于乳清蛋白
B. 母乳脂肪中不饱和必需脂肪酸含量较少
C. 母乳钙磷比例适宜，钙吸收率高
D. 母乳矿物质含量高于牛乳
E. 母乳铁的吸收率高于牛乳，可达30%

正确答案：C。母乳钙磷比例适宜，钙吸收率高

解析：本题考查婴儿喂养方式的相关内容。母乳中含多种维生素和微量元素，如母乳中钙磷比例适宜，钙吸收率高（C对），人乳中铁的吸收率为50%（E错）也高于牛乳，母乳总矿物质含量约为牛乳的1/3（D错）。母乳是婴儿最好的天然食物，母乳所合营养素质量最适合婴儿的需求，消化吸收和利用率较高。母乳蛋白质所含乳清蛋白多于酪蛋白（A错），在胃内形成的凝块细小、柔软适合婴儿消化吸收。母乳中含较多不饱和脂肪酸（B错），特别是亚油酸含量丰富，对小婴儿脑发育十分重要。